女，50岁，渐进性胸闷，气短3周。右肺叩诊呈实音，听诊右肺呼吸音明显减弱，胸部X线片示右侧大量胸腔积液。胸穿抽出血性胸水700ml。胸水化验CEA明显增高。胸膜病变最可能的病理类型为
A. 恶性胸膜间皮瘤
B. 腺癌
C. 小细胞癌
D. 大细胞癌
E. 鳞癌

正确答案：B。腺癌

解析：老年女性，渐进性胸闷，气短，右肺叩诊呈实音，右肺呼吸音明显减弱（肺部症状），胸穿抽出血性胸水，CEA明显增高（癌性胸水）。最可能为肺癌。肺癌最可能的病理类型为腺癌（B对）。